女，35岁。继发性痛经5年，加重1年，平素月经规律，结婚8年，近2年未避孕，G0P0。妇科检查：左附件区囊肿，直径约6cm，活动度差，触痛，CA12586U/ml，最佳的处理是
A. 注射GnRH-α
B. 手术治疗
C. 期待疗法
D. 口服避孕药
E. 服用孕三烯酮

正确答案：B。手术治疗

解析：中青年女性，继发性痛经，进行性加重，不孕，左附件区囊肿，直径约6cm（≥4cm手术指征之一），活动度差，触痛，CA12586U/ml，据患者临床表现、查体及实验室检查诊断为子宫内膜异位症。对于子宫内膜异位症的治疗，分为药物治疗和手术治疗：前者如注射GnRH-α（A错）、口服避孕药（D错）及口服孕三烯酮均可通过抑制垂体促性腺激素释放而抑制性激素合成、分泌及作用，适用于无卵巢囊肿形成患者；对较大的卵巢内膜异位囊肿≥4cm者，特别是卵巢包块性质未明者，宜采用手术治疗（B对）。